用于衡量一个国家（人群）社会卫生状况的指标是
A. 新生儿死亡率和孕产妇死亡率
B. 发病率、患病率
C. 患病率、病死率
D. 出生率、死亡率
E. 婴儿死亡率和平均期望寿命

正确答案：E。婴儿死亡率和平均期望寿命